（132～135题共用题干）女，30岁。妊娠40周。临产12小时后在产钳助娩下分娩一4100g女婴。胎儿娩出后15分钟胎盘人工剥离取出，检查胎盘无异常，继之发生阴道大量流血。下面的处理不恰当的是
A. 刮宫术
B. 配血
C. 子宫注射或静脉滴注缩宫药物
D. 迅速补液
E. 按摩子宫

正确答案：A。刮宫术

解析：该女性患者诊断考虑为宫缩乏力性产后出血，阴道流血大量，此时应迅速补液（D对）预防休克，同时配血（B对），若休克发生及时输血。加强宫缩能迅速止血具体方法有按摩子宫（E对）及应用宫缩剂（C对）。刮宫术（A错，为本题正确答案）为胎盘滞留引起的产后出血的处理措施。